不属于突发公共卫生事件的是
A. 张某吃了不洁食物造成的食物中毒事件
B. 2003年在某地发生的井喷硫化氢事件
C. 群体性不明原因疾病
D. 某工厂发生的苯中毒事件
E. 某医院的放射源丢失事件

正确答案：A。张某吃了不洁食物造成的食物中毒事件